与队列研究样本量大小有关的是
A. 暴露组与非暴露组的疾病发病率
B. 病例组人群的暴露率
C. 暴露组的疾病死亡率
D. 人群的平均暴露水平
E. 人群中暴露的比例

正确答案：A。暴露组与非暴露组的疾病发病率

解析：本题考查队列研究样本量的影响因素。影响样本量的因素有：1.一般人群（对照人群）中所研究疾病的发病率；2.暴露组与对照组人群发病率之差（d）（A对BCDE错）：d越大，所需样本量越小；3.要求的显著性水平：即检验假设时的第一类错误越小，样本量越大；4.效力：检验假设时的第二类错误越小，需要的样本量越多。